男，29岁。间断腹痛腹泻黏液血便1年，加重2周，大便10余次。静点左氧氟沙星及甲硝唑10天后症状无好转，T39℃，Hb75g/L，粪便培养未见致病菌生长。结肠镜示全结肠弥漫性充血水肿，伴糜烂及不规则浅溃疡，病理为重度慢性炎症。隐窝脓肿形成。该患者首先考虑的诊断是
A. 肠结核
B. 溃疡性结肠炎
C. 肠易激综合征
D. 克罗恩病
E. 慢性细菌性痢疾

正确答案：B。溃疡性结肠炎

解析：青年男性患者，间断腹痛、腹泻、黏液血便（黏液血便是溃疡性结肠炎活动期的重要表现）1年。大便10余次/日，T39℃，Hb75g/L（符合重度溃疡性结肠炎：腹泻＞6次/日，有明显黏液脓血便，体温＞37.5℃、脉搏＞90次/分，血红蛋白＜100g/L，血沉＞30mm/h）。抗生素治疗无效，粪便培养未见致病菌生长（与慢性细菌性痢疾鉴别）。结肠镜：全结肠弥漫性充血、水肿，伴糜烂及不规则浅溃疡（溃疡性结肠炎的结肠镜特点为：溃疡浅，黏膜弥漫性充血水肿、颗粒状，脆性增加）。病理：重度慢性炎症，隐窝脓肿形成（溃疡性结肠炎的病理特点为固有膜全层弥漫性炎症、隐窝脓肿、杯状细胞减少）。综合该患者的病史、实验室检查、结肠镜及病理检查，考虑诊断为溃疡性结肠炎（B对）。肠结核（P368）（A错）好发于回盲部，常有结核毒血症状，无脓血便，结肠镜检查可见溃疡呈带状，长径与肠轴垂直。肠易激综合征（P386）（C错）以腹痛或腹部不适伴排便习惯改变为特征，无黏液脓血便，结肠镜检查无明显改变。克罗恩病（P377）（D错）好发于回肠末段，临床以腹痛、腹泻、体重下降、腹块、瘘管形成和肠梗阻为特点，结肠镜检查可见纵行溃疡和裂隙溃疡、鹅卵石征，病变间的黏膜正常，病理见裂隙状溃疡、非干酪性肉芽肿、黏膜下层淋巴细胞聚集。慢性细菌性痢疾（E错）可有黏液脓血便，但抗生素治疗有效，粪便培养可见致病菌生长，结肠镜检查可见地图状溃疡。